赫恩小体出现在
A. 红细胞内
B. 白细胞内
C. 血小板内
D. 细胞间质中

正确答案：A。红细胞内

解析：本题考查赫恩滋小体的性质。赫恩滋小体是由于苯的氨基硝基化合物作用于珠蛋白分子中的巯基（-SH），使球蛋白变性从而形成的。赫恩滋小体呈圆形，或椭圆形，位于细胞边缘或附着于红细（A对BCD错）膜上，有赫恩滋小体的红细胞极易破裂，引起溶血。